某女，49岁，经血非时而下，出血量多，淋沥不尽，色淡质稀，两目干涩，腰膝酸软，面色晦暗；舌淡暗，脉沉弱。患者服用一段时间后，症状好转，血量减少，要求改服中成药，应选用的中成药是
A. 定坤丹
B. 乌鸡白凤丸
C. 女金丸
D. 安坤赞育丸
E. 坤灵丸

正确答案：D。安坤赞育丸

解析：本题考查的是崩漏的辨证论治。经血非时而下，出血量多，淋沥不尽，色淡质稀，两目干涩，腰膝酸软，面色晦暗；舌淡暗，脉沉弱。患者服用一段时间后，症状好转，血量减少，要求改服中成药，应选用的中成药是安坤赞育丸（D对）。崩漏是月经的周期、经期、经量发生严重失常的病证，经血非时暴下不止或不尽，前者谓之崩中，后者谓之漏下。崩与漏出血情况虽不同，然二者常相互转化，交替出现，且其病因病机基本相同，故概称崩漏。西医学中的无排卵性功能性子宫出血，可参照本证进行辨证治疗。（一）气血两虚证：【症状】出血量多或淋沥不尽，血色淡薄，面色无华，气短懒言，食欲不振，便溏。舌质淡，苔薄白湿润，脉细弱。【中成药应用】常用中成药有定坤丹（A错）、乌鸡白凤丸（B错）、养血饮口服液。（二）脾不统血证：【症状】出血量多，日久而止，气短神疲，面色㿠白，或面浮肢肿，手足不温，或饮食不佳，大便溏。舌质淡，苔薄白，脉弱或沉弱。【中成药应用】常用中成药有人参归脾丸、阿胶三宝膏、山东阿胶膏。（三）肝肾不足证：【症状】月经非时而下，或月经先期，经期延长，经血暗红，量少而淋沥不畅，咽干颧红，心烦潮热，腰膝酸软。舌红苔少或光剥苔，脉沉细无力。【中成药应用】常用中成药有妇科止血灵片、安坤赞育丸、春血安胶囊。（四）瘀血阻络证：【症状】经血非时而下，量时多时少，时出时止，或淋沥不断，或停闭数月又突然崩中，继之漏下，经色暗有血块；舌质紫暗或尖边有瘀点，脉弦细或涩。【中成药应用】常用中成药有宫血停颗粒、四物胶囊、茜芷胶囊。女金丸（C错）为月经先期肾气虚证的中成药应用。月经先期肾气虚证：【症状】月经周期提前，经量或多或少，色淡暗，质清稀；腰膝酸软，头晕耳鸣，面色晦暗或面有暗斑。舌淡暗，苔白，脉沉细。【中成药应用】常用中成药有女金丹丸。中成药应用为坤灵丸（E错）的病证，2022年考试指南未明确说明。